患者女性36岁，左上456残根，既往曾有风湿性心脏病，现存在二尖瓣狭窄，心功能I级，此患者最佳治疗方案为
A. 左上456分次拔除，术前术后预防性使用抗生素
B. 左上456分次拔除，术后预防性使用抗生素
C. 左上456分次拔除，术前预防性使用抗生素
D. 左上456一次拔除，术前术后预防性使用抗生素
E. 左上456一次拔除，术前预防性使用抗生素

正确答案：D。左上456一次拔除，术前术后预防性使用抗生素

解析：本题考查心脏病患者拔牙的治疗方法。左上456一次拔除，术前术后预防性使用抗生素（D对E错）是最佳治疗方案。该患者左上456残根，应拔除；心功能I级是可以耐受拔牙的，一次拔除相对分次拔除（ABC错），可以减少麻醉次数、细菌的感染机会、及患者的创伤和心脏病发的可能；该患者曾有风湿性心脏病，现存在二尖瓣狭窄，是细菌性心内膜炎的易感人群，要在术前术后预防性使用抗生素，以预防细菌性心内膜炎的发生。